急性减压病出现最早且较普遍的表现为
A. 神经系统的改变
B. 循环系统的改变
C. 呼吸系统的改变
D. 皮肤改变
E. 肌肉、关节、骨骼系统的改变

正确答案：D。皮肤改变